下列除哪项外，均为妊娠病的发病机制
A. 血聚养胎，阴血偏虚，阳气偏亢
B. 胎体渐大，气机升降失调
C. 寒湿停聚，冲任受阻
D. 肾气不足，无力系胞，胎元不固
E. 脾胃虚弱，化源不足，影响胎元

正确答案：C。寒湿停聚，冲任受阻

解析：妊娠病的发病机理常有阴血虚、脾肾虚、冲气上逆、气滞四种。阴血素虚，孕后血聚宫养胎，阴血益虚，可致阴虚阳亢而发为妊娠病（A对）。素多忧郁，气机不畅，腹中胎体渐大，易致气机升降失常，气滞则血瘀水停而发为妊娠病，属气滞（B对）。寒湿停聚，冲任受阻多导致月经后期、闭经、不孕等病，妊娠病可为脾虚湿聚，泛溢肌肤或水停胞中而发病（C错，为本题正确答案）。肾气虚弱，胎失所系，胎元不固而发为妊娠病，属脾肾虚（D对）。脾胃虚弱，化源不足，影响胎元而发为妊娠病，属脾肾虚（E对）。